下列关于定期健康检查说法错误的是
A. 健康检查需在预防接种后进行
B. 每次健康检查时间不应少于5～10分钟
C. 6～9个月以上婴儿应检查一次血红蛋白或血常规
D. 儿童4岁开始每年采用国际标准视力表或标准对数视力表灯箱进行一次视力筛查
E. 健康检查可根据儿童个体情况，结合预防接种时间或本地区实际情况适当调整

正确答案：A。健康检查需在预防接种后进行

解析：本题考查定期健康检查的相关内容。健康检查需在预防接种前进行（A错，为本题正确答案），就诊环境布置应便于儿童先体检、后预防接种。定期健康检查每次健康检查时间不应少于5～10分钟（B对）；6～9个月以上婴儿应检查一次血红蛋白或血常规（C对）；儿童4岁开始每年采用国际标准视力表或标准对数视力表灯箱进行一次视力筛查（D对）；健康检查可根据儿童个体情况，结合预防接种时间或本地区实际情况适当调整（E对）。